引起咯血最常见的病因是
A. 慢性支气管炎
B. 肺脓肿
C. 肺结核
D. 肺炎
E. 肺不张

正确答案：C。肺结核